患者恶寒较甚，发热，无汗，身楚倦怠，咳嗽，咳痰无力，舌淡苔薄白，脉浮无力。治疗应首选
A. 杏苏散
B. 参苏饮
C. 荆防败毒散
D. 葛根汤
E. 桂枝汤

正确答案：B。参苏饮

解析：题中患者以恶寒，发热，无汗，咳嗽为主症，故诊断为感冒。由于卫气不固，外感风寒，气虚托送无力，邪不易解，恶寒较甚，发热，无汗，身楚倦怠，咳嗽，咳痰无力，舌淡苔薄白，脉浮无力。治宜益气解表，方用参苏饮加减（B对）。杏苏散功能清宣凉燥，理肺化痰，为治疗咳嗽风燥伤肺证选方（A错）。荆防败毒散功能辛温发汗，疏风祛湿，为治疗感冒风寒束表证选方（C错）。葛根汤功能解肌发汗，为痉证刚痉的选方（D错）。桂枝汤功能解肌发表，调和营卫，主治外感风寒表虚证（E错）。